金银花除能清热解毒外，又能
A. 疏散风热
B. 凉血消斑
C. 利湿退黄
D. 祛痰利咽
E. 活血止痛

正确答案：A。疏散风热

解析：本题考查的是金银花的功效。金银花除能清热解毒外，又能疏散风热（A对）。金银花：【功效】清热解毒，疏散风热。大青叶：【功效】清热解毒，凉血消斑（B错），利咽消肿。垂盆草：【功效】清热解毒，利湿退黄（C错）。射干：【功效】清热解毒，祛痰利咽（D错），散结消肿。。大血藤：【功效】清热解毒，活血止痛（E错），祛风通络。